白血病的牙龈病损的治疗原则是
A. 立即彻底清除菌斑和牙石
B. 保守治疗为主、止血、抗感染
C. 切除肥大的牙龈
D. 根面平整
E. 使用牙周塞治剂预防牙龈出血

正确答案：B。保守治疗为主、止血、抗感染

解析：本题考查白血病的牙龈病损的治疗原则。白血病的牙龈病损有明显的出血倾向，龈缘常有渗血，且不易止住，白血病患者全身免疫力低下，因此治疗以保守治疗为主、止血、抗感染（B对）。立即彻底清除菌斑和牙石（A错）、切除肥大的牙龈（C错）和根面平整（D错）易发生出血不止或感染、坏死，应在止血的基础上，用3%过氧化氢溶液轻轻清洗坏死龈缘，然后敷以消炎药或碘制剂，用0.12%～0.2%氯己定溶液含漱有助于减少菌斑、消除炎症。遇出血不止时，使用牙周塞治剂止血，在无出血时不需使用牙周塞治剂预防牙龈出血（E错），因为牙周塞治剂凝固后质地变坚硬会刺激未出血牙龈出血。